阳气虚衰，气血运行不畅最常见的舌象是
A. 青紫舌
B. 淡紫舌
C. 绛紫舌
D. 点刺舌
E. 瘦薄舌

正确答案：B。淡紫舌

解析：“淡紫舌属于青紫舌的范畴，表现为舌淡而泛现青紫色，多因肺气壅滞，或肝郁血瘀，或气虚无力推动血液运行，使血流缓慢所致，亦可见于先天性心脏病，或某些药物、食物中毒等”，故阳气虚衰，气血运行不畅最常见的舌象是淡紫舌（B对）。“青紫舌表现为全舌呈现紫色，或局部现青紫斑点，提示血气瘀滞(A错)。绛紫舌属于青紫舌的范畴，表现为舌绛而泛现青紫色，为热毒炽盛，营阴受灼，津液耗损，气血壅滞所致”（C错）。“点刺舌，点是指突起于舌面的红色或紫红色星点。大者为星，称红星舌；小者为点，称红点舌。刺是指舌乳头突起如刺，摸之棘手的红色或黄黑色点刺，称为芒刺舌。提示脏腑热极，或为血分热盛”（D错）。“瘦薄舌表现为舌体瘦小而薄，多主气血两虚，阴虚火旺”（E错）。